女，43岁。右下颌后牙多个残根，风湿性心脏病10余年，二尖瓣狭窄，心功能Ⅰ级。对于该患者最佳的治疗方案是
A. 分次拔除患牙，术前预防性使用抗生素
B. 分次拔除患牙，术后预防性使用抗生素
C. 分次拔除患牙，术前术后预防性使用抗生素
D. 一次拔除全部患牙，术前预防性使用抗生素
E. 一次拔除全部患牙，术前术后预防性使用抗生素

正确答案：E。一次拔除全部患牙，术前术后预防性使用抗生素

解析：本题考查拔牙。女，43岁。右下颌后牙多个残根，风湿性心脏病10余年，二尖瓣狭窄，心功能Ⅰ级。对于该患者最佳的治疗方案是一次拔除全部患牙，术前术后预防性使用抗生素（E对）。拔牙操作可能引起一过性的菌血症；风湿性心脏病和其他获得性瓣膜功能不全是菌血症引发细菌性心内膜炎的易感人群；预防性使用抗生素是心脏瓣膜疾病患者接受口腔有创处理前所必需的，对于心瓣膜病患者应改善口腔卫生情况后，术前按药物血浆浓度峰值产生时间使用青霉素族抗生素（无过敏史者）；术后也应应用抗生素以避免感染。综上所述，此风湿性心脏病患者心功能Ⅰ级可耐受拔牙，拔牙时应一次性拔除全部患牙，且在拔牙治疗之前，应该做好相应的准备措施，术前术后三天内都必须应用有效的抗生素，以尽量避免感染的发生。